有双侧肾动脉狭窄的高血压患者不宜选用
A. 维拉帕米
B. 氢氯噻嗪
C. 多沙唑嗪
D. 卡托普利
E. 硝酸甘油

正确答案：D。卡托普利

解析：本题考查药物的禁忌症。有双侧肾动脉狭窄的高血压患者不宜选用卡托普利（D对）。卡托普利为血管紧张素转换酶抑制剂，血管紧张素转换酶抑制剂（ACEI）禁用于双侧肾动脉狭窄、高钾血症及妊娠期。维拉帕米（A错）为非二氢吡啶类钙通道阻滞药，禁用于二至三度房室传导阻滞、心力衰竭患者。氢氯噻嗪（B错）为中效利尿剂，痛风者禁用。多沙唑嗪（C错）为长效α₁受体阻断剂，体位性低血压患者禁用。硝酸甘油（E错）为硝酸酯类抗心绞痛药物。